以下我国卫生法的表现形式，错误的是
A. 宪法
B. 卫生法律、法规、规章
C. 卫生标准
D. 政府红头文件
E. 卫生国际条约

正确答案：D。政府红头文件